经代谢转变后，能抑制脱氧胸苷酸合成酶，干扰核算代谢的药物是
A. 门冬酰胺酶
B. 长春新碱
C. 长春碱
D. 氟尿嘧啶
E. 巯嘌呤

正确答案：D。氟尿嘧啶

解析：5-氟尿嘧啶（5-FU）是尿嘧啶5位上的氢被氟取代的衍生物。5-FU在细胞内转变为5氟尿嘧啶脱氧核苷酸，而抑制脱氧胸苷酸合成酶，阻止脱氧鸟苷酸甲基化转变为脱氧胸苷酸，从而影响DNA的合成（D对）。